下列有机溶剂中，属于第二类溶剂的有
A. 苯
B. 醋酸
C. 二氯甲烷
D. 三氯甲烷
E. 乙醇

正确答案：C、D。二氯甲烷；三氯甲烷

解析：本题考查有机溶剂的分类。第一类是应该避免使用的溶剂，一般为致癌物或危害环境的物质，共有5种，包括苯、四氯化碳等；第二类是应限制使用的溶剂，一般具有非基因毒性，不可逆或可逆毒性，共有27种，包括二氟甲烷（C对）、三氟甲烷（D对）等；第三类是毒性低，对人体危害较小的溶剂，共有27种；第四类溶剂目前尚无足够毒理学资料证实其毒性，生产企业在使用时应提供该类溶剂在药品中残留水平的合理性报告。